某男，63岁，痹证日久不愈，肢体、关节疼痛，屈伸不利，关节肿大僵硬、变形，肌肉萎缩，筋脉拘急，肘膝不伸，以尻代踵，以背代头，腰膝酸软，骨蒸潮热：舌红，脉细数。应选用的中成药有
A. 痹痛宁胶嚢
B. 湿热痹颗粒
C. 尪痹颗粒
D. 风湿骨痛丸
E. 益肾蠲痹丸

正确答案：C、E。尪痹颗粒；益肾蠲痹丸

解析：本题考查的是痹症的辨证论治。痹证日久不愈，肢体、关节疼痛，屈伸不利，关节肿大僵硬、变形，肌肉萎缩，筋脉拘急，肘膝不伸，以尻代踵，以背代头，腰膝酸软，骨蒸潮热：舌红，脉细数。应选用的中成药有尪痹颗粒（C对）、益肾蠲痹丸（E对）。痹证是由于风、寒、湿、热等邪气闭阻经络，影响气血运行，导致肢体筋骨、关节、肌肉等处发生疼痛、重着、酸楚、麻木，或关节屈伸不利、僵硬、肿大、变形等症状的疾病。轻者病在四肢关节肌肉，重者可内舍于脏。西医学的风湿性关节炎、类风湿关节炎、反应性关节炎、肌纤维炎、强直性脊柱炎、痛风、增生性骨关节炎等出现痹证的临床表现时，均可参考此内容辨证论治。（一）行痹：【症状】肢体关节、肌肉疼痛酸楚，关节屈伸不利，可涉及肢体多个关节，疼痛呈游走性，初起可见恶风、发热等表证。舌苔薄白，脉浮或浮缓。【中成药应用】常用中成药有九味羌活丸。（二）痛痹：【症状】肢体关节疼痛，痛势较剧，部位固定，遇寒则痛甚，得热则痛缓，关节屈伸不利，局部皮肤或有寒冷感。舌质淡，舌苔薄白，脉弦紧。【中成药应用】常用中成药有风湿定片、寒湿痹颗粒。（三）着痹：【症状】肢体关节、肌肉酸楚、重着、疼痛，肿胀散漫，关节活动不利，肌肤麻木不仁。舌质淡，舌苔白腻，脉濡缓。【中成药应用】常用中成药有寒湿者可选风湿痹康胶囊、痹痛宁胶囊（A错）、四妙丸、湿热痹颗粒（B错）。（四）尪痹：【症状】痹证日久不愈，肢体、关节疼痛，屈伸不利，关节肿大僵硬、变形，甚则肌肉萎缩，筋脉拘急，肘膝不伸，或以尻代踵，以背代头，伴腰膝酸软、骨蒸潮热、自汗、盗汗。舌红或淡，脉细数。【中成药应用】常用中成药有独活寄生合剂、尪痹颗粒、天麻丸、益肾蠲痹丸。中成药应用为风湿骨痛胶囊（D错）的病证，2022年考试指南未明确说明。